无牙颌口腔专项检查内容不包括
A. 上下颌弓、牙槽嵴的大小、形态和位置
B. 牙槽嵴吸收情况
C. 口腔黏膜检查
D. 舌的大小、形状、及功能状态等
E. 唾液分泌量、pH值和黏稠度

正确答案：E。唾液分泌量、pH值和黏稠度

解析：本题考查无牙颌口腔专项检查。无牙颌口腔专项检查内容不包括唾液分泌量、pH值和黏稠度（E错，为本题的正确答案）。牙列缺失后，咀嚼功能遭到破坏，并引起口腔颌面部发生一系列的形态和功能的变化，因此在制取全口义齿之前要重新对口腔进行专项检查，其中包括上下颌弓、牙槽嵴的大小、形态和位置（A对）以及牙槽嵴吸收情况（B对），因为颌弓的位置和形态以及牙槽骨吸收程度影响全口义齿的固位。另外，由于全口义齿主要依靠大气压力和吸附力固位，对口腔黏膜（C对）的要求较高，基托区的黏膜应正常，无黏膜破溃、炎症性增生等情况。除此之外，舌的大小、形状以及功能状态（D对）也会对全口义齿产生影响，如舌体过大或活动性较强也不利于义齿固位。但一般来说，唾液分泌量、pH值和黏稠度虽然会对义齿固位产生影响，但通常不作为无牙颌口腔专项检查内容。